制剂处方中含有果胶辅料的药品是
A. 维生素C泡腾颗粒
B. 蛇胆川贝散
C. 板蓝根颗粒
D. 元胡止痛滴丸
E. 利福昔明干混悬颗粒

正确答案：E。利福昔明干混悬颗粒

解析：本题考查利福昔明干混悬颗粒。制剂处方中含有果胶辅料的药品是利福昔明干混悬颗粒（E对）；维生素C泡腾颗粒（A错）中维生素C为主药，枸橼酸、碳酸氢钠为泡腾崩解剂，柠檬黄为着色剂，糖粉为稀释剂，糖精钠和食用香料为矫味剂，蒸馏水和乙醇为溶剂；蛇胆川贝散（B错）制剂处方中不含辅料；板蓝根颗粒（C错）中板蓝根为主药，糊精、蔗糖为稀释剂，其中蔗糖也是矫味剂。